房间隔和室间隔的描述哪项不正确
A. 室间隔分肌部和膜部
B. 卵圆窝是房间隔缺损的好发部位
C. 在卵圆窝处房间隔最薄
D. 膜部是室间隔缺损的好发部位
E. 膜部缺乏心内膜

正确答案：E。膜部缺乏心内膜

解析：室间隔可分为肌部和膜部两部分（A对）。卵圆窝是房间隔最薄弱处（C对），也是房间隔缺损的好发部位（B对）。膜部是室间隔缺损的好发部位（D对）。膜部有心内膜（E错，为本题正确答案），并不缺乏。